主治医师邱某经过抗菌药物临床应用知识和规范化管理培训并考核合格后，被授予限制使用级抗菌药物处方权。但不久，邱某因违反《抗菌药物临床应用管理办法》的相关规定，受到医院警吿并限制其上述处方权。医院处理邱某的依据是
A. 多次使用非限制使用级抗菌药物
B. 使用价格相对较高的抗菌药物
C. 在紧急情况下越级使用抗菌药物
D. 无正当理由开具抗菌药物超常处方3次以上
E. 在门诊使用限制使用级抗菌药物

正确答案：D。无正当理由开具抗菌药物超常处方3次以上

解析：医疗机构应当对出现抗菌药物超常处方3次以上且无正当理由的医师提出警告，限制其特殊使用级和限制使用级抗菌药物处方权（D对）。